药师在指导合理用药时应正确的交代给药途径和给药方法。下列交代的内容，错误的是
A. 活菌制剂不能用超过40℃的水送服
B. 肠溶片要整片吞服，不宜嚼碎服用
C. 栓剂是外用制剂，不可口服
D. 泡腾片可以溶解于温开水后服用，也可以作为咀嚼片服用
E. 骨架型缓释片服用后，会随粪便排出类似完整药片的制剂骨架，告知患者不用疑惑

正确答案：D。泡腾片可以溶解于温开水后服用，也可以作为咀嚼片服用

解析：本题考查不同剂型药物的使用。泡腾片遇水可产生大量二氧化碳气体，促进片剂崩解，应用温水或凉水溶解，严禁直接服用或含服（D错，为本题正确答案）。活菌制剂低温或高温都会导致失活无效，送服时不能用超过40℃的水（A对）。服用肠溶片的目的是避免在酸性胃环境中崩解，宜整片吞服（B对）。栓剂是外用腔道固体制剂，不可口服（C对）。骨架型缓释片是通过使用不溶性骨架材料来起缓释作用，故发挥药效后骨架随粪便排出，不会溶解（E对）。